我国卫生法的立法依据是
A. 《中华人民共和国宪法》
B. 《中华人民共和国刑法》
C. 《中华人民共和国传染病防治法》
D. 《中华人民共和国食品卫生法》
E. 《中华人民共和国执业医师法》

正确答案：A。《中华人民共和国宪法》